传染源通过产生（＞5μm）微生物的飞沫传播的是
A. 直接接触传播
B. 间接接触传播
C. 飞沫传播
D. 空气传播
E. 性传播

正确答案：C。飞沫传播

解析：飞沫传播：传染源产生带有微生物的飞沫（＞5μm）在空气中移行短距离后移植到宿主的上呼吸道而导致的传播，是一种近距离（1m以内）传播。掌握“口腔医疗保健中的感染”知识点。